下列关于口罩佩戴方法不正确的是
A. 口腔检查及治疗过程医护人员必须配戴口罩
B. 为了降低成本，同一口罩可看多名病号
C. 在治疗中，不能用手套触摸口罩
D. 治疗结束后先脱手套再摘口罩
E. 口罩一旦潮湿或污染了，必须更换

正确答案：B。为了降低成本，同一口罩可看多名病号

解析：口罩：口罩保护面部不受碎片污染和防止吸入污染的飞沫，配戴时应完全覆盖鼻部与嘴部。整个口腔检查及治疗过程，医护人员都必须保持配戴口罩。接诊每个患者都应使用新的口罩；在治疗中，不能用手套触摸口罩：治疗结束后先脱手套再摘口罩。口罩一旦潮湿或污染了，必须更换，因为湿润的口罩不仅不舒服，而且降低了阻隔病原体的作用。掌握“患者、医务人员及环境的防护”知识点。